(V6)导联，可以确定梗死的部位是
A. 前间壁
B. 前壁
C. 侧壁
D. 下壁(膈面）
E. 正后壁

正确答案：C。侧壁

解析：心肌梗死特征性心电图出现在I、aVL、V5 (V6)导联，可以确定梗死的部位是侧壁（C对）。前间壁为V1～V3导联（A错）。前壁为V3～V5导联（B错）。下壁(膈面）为Ⅱ、Ⅲ、aVF导联（D错）。正后壁为V7～V9导联（E错）。